下列关于凝胶剂质量要求的说法，正确的有
A. 混悬型凝胶剂中胶粒应分散均匀，不应下沉、结块
B. 凝胶剂应均匀、细腻，在常温时保持胶状，不干涸或液化
C. 凝胶剂根据需要可加入保湿剂、抑菌剂、抗氧剂
D. 除另有规定外，凝胶剂应避光、密闭贮存，并应防冻
E. 凝胶剂一般不检查pH和渗透压

正确答案：A、B、C、D。混悬型凝胶剂中胶粒应分散均匀，不应下沉、结块；凝胶剂应均匀、细腻，在常温时保持胶状，不干涸或液化；凝胶剂根据需要可加入保湿剂、抑菌剂、抗氧剂；除另有规定外，凝胶剂应避光、密闭贮存，并应防冻

解析：本题考查凝胶剂的质量要求。凝胶剂的质量要求：（1）混悬型凝胶剂中胶粒应分散均匀，不应下沉、结块（A对）；（2）凝胶剂应均匀、细腻，在常温时保持胶状，不干涸或液化（B对）；（3）凝胶剂根据需要可加入保湿剂、抑菌剂、抗氧剂（C对）；（4）凝胶剂一般应检查pH（E错）；（5）凝胶剂基质与药物间均不应发生理化作用；（6）除另有规定外，凝胶剂应避光，密闭贮存，并应防冻（D对）。